氨基酸脱下的氨，在有氧的条件下，经亚硝酸细菌和硝酸细菌的作用转化为硝酸的过程为
A. 硫化作用
B. 腐殖质化作用
C. 氨化作用
D. 亚硝化作用
E. 硝化作用

正确答案：E。硝化作用

解析：本题考查硝化作用。氨基酸脱下的氨以氧为催化剂，在有氧的条件下，经亚硝酸细菌和硝酸细菌的作用发生氧化反应，最终转化为硝酸，这一过程为硝化作用（E对ABCD错）。